某男，因患慢性心衰，长期服用强心苷类药物，现咽喉红肿疼痛，音哑失声。下列中成药中，不宜与强心苷类药物同用的中成药是
A. 清音丸
B. 金果饮
C. 六神丸
D. 黄氏响声丸
E. 牛黄解毒片

正确答案：C。六神丸

解析：本题考查的是中西药联用药理作用相加产生毒副作用。下列中成药中，不宜与强心苷类药物同用的中成药是六神丸（C对）。中西药联用时药理作用相加产生毒副作用：些中西成药均具有较强的药理作用，合用后药理作用相互加强产生毒性作用。强心苷有较强的生理效应，如过量会引起中毒。故六神丸、救心丹等含有蟾酥、罗布麻、夹竹桃等强心苷成分的中成药，不宜与洋地黄、地高辛、毒毛花苷K等强心苷类同用。清音丸（A错）、金果饮（B错）、黄氏响声丸（D错）、牛黄解毒片（E错）的联用禁忌，2022年考试指南未明确说明。